肠溶衣包衣过程应选择的材料是
A. 丙烯酸树脂Ⅱ号
B. 羟丙基甲基纤维素
C. 玉米朊乙醇溶液
D. 滑石粉
E. 川蜡

正确答案：A。丙烯酸树脂Ⅱ号

解析：本题考查片剂的包衣。丙烯酸树脂Ⅱ号（A对）属于肠溶包衣材料；羟丙基甲基纤维素（B错）为高分子包衣材料；玉米朊乙醇溶液（C错）为隔离层材料；滑石粉（D错）为粉衣层材料；川蜡（E错）为打光包衣的材料。